心力衰竭是指
A. 下肢水肿
B. 血压下降
C. 心脏舒缩功能障碍，心输出量下降
D. 肺部淤血
E. 心脏肥大

正确答案：C。心脏舒缩功能障碍，心输出量下降

解析：各种病因使心脏收缩和（或）舒张功能受损，心泵功能减退，心输出量减少，引起器官组织灌流量减少和肺循环、体循环淤血，导致心力衰竭。因而描述心力衰竭较为准确全面的概念是心脏舒缩功能障碍，心输出量下降（C对）。下肢水肿（A错）、血压下降（B错）、肺部淤血（D错）、心脏肥大（E错）均是心衰过程中可能出现的临床表现，不能完整的描述心衰的概念。